患者身常汗出，夜卧尤甚，久而不止心悸惊惕，短气烦倦。治疗应首选
A. 牡蛎散
B. 归脾汤
C. 补中益气汤
D. 四物汤
E. 黄土汤

正确答案：A。牡蛎散

解析：本题考查常见的病症的辩证、处方。题中患者身常汗出，夜卧尤甚，久而不止心悸惊惕，短气烦倦，证属体虚自汗、盗汗证。牡蛎散为固涩剂，具有敛阴止汗，益气固表之功效。主治体虚自汗、盗汗证。常自汗出，夜卧更甚，心悸惊惕，短气烦倦，舌淡红，脉细弱（A对）。归脾汤为补益剂，具有益气补血，健脾养心之功效。主治心脾气血两虚证。心悸怔忡，健忘失眠，盗汗，体倦食少，面色萎黄，舌淡，苔薄白，脉细弱；脾不统血证。便血，皮下紫癜，妇女崩漏，月经超前，量多色淡，或淋漓不止，舌淡，脉细弱（B错）。补中益气汤为补益剂，具有补中益气，升阳举陷之功效。主治脾虚气陷证。饮食减少，体倦肢软，少气懒言，面色萎黄，大便稀溏，舌淡，脉虚；以及脱肛、子宫脱垂、久泻久痢，崩漏等（C错）。四物汤主治营血虚滞证。心悸失眠，头晕目眩，面色无华，妇人月经不调，经量少或闭经，表现为舌淡，脉细弦或细涩（D错）。黄土汤理血剂，具有温阳健脾，养血止血之功效。主治脾阳不足，脾不统血证。大便下血，先便后血，以及吐血、衄血、妇人崩漏，血色暗淡，四肢不温，面色萎黄，舌淡苔白，脉沉细无力（E错）。